腰椎穿刺的禁忌情况是
A. 高热
B. Kernig征阳性
C. Babinski征阳性
D. 癫痫发作后
E. 休克

正确答案：E。休克

解析：休克（E对）患者病情危重不宜搬动，为腰椎穿刺的禁忌症。其余四项均为腰穿适应症。高热（A错）患者可腰穿留取脑脊液（CSF）做检查以助明确发热原因。Kernig征阳性（B错）可留取CSF检查以助明确脑膜刺激征的性质和原因。Babinski征阳性（C错）可留取CSF做检查以助明确椎体束受损的原因。癫痫发作后（D错）患者可留取CSF做检查有助判断癫痫症状是否与中枢神经系统出血、炎症等有关。